患者，男，66岁。风邪初中经络，口眼歪斜，舌强不能言语，手足不能运动。治疗应首选
A. 牵正散
B. 小活络丹
C. 镇肝熄风汤
D. 大定风珠
E. 大秦艽汤

正确答案：E。大秦艽汤

解析：本题考查常见的病症的辩证、处方。题中患者风邪初中经络，口眼歪斜，舌强不能言语，手足不能运动，证属风邪初中经络证。牵正散为治风剂，具有祛风化痰，通络止痉之功效。主治风中头面经络。口眼歪斜，或面肌抽动，舌淡红，苔白（A错）。小活络丹，为治风剂，具有祛风除湿，化痰通络，活血止痛之功效。主治风寒湿痹证。肢体筋脉疼痛，麻木拘挛，关节屈伸不利，疼痛游走不定，舌淡紫，苔白，脉沉弦或涩；中风。手足不仁，日久不愈，腰腿沉重，或腿臂间作痛（B错）。镇肝熄风汤为治风剂，具有镇肝熄风，滋阴潜阳之功效。主治类中风。头目眩晕，目胀耳鸣，脑部热痛，面色如醉，心中烦热，或时常噫气，或肢体渐觉不利，口眼渐形喁斜；甚或眩晕颠仆，昏不知人，移时始醒，或醒后不能复元，脉弦长有力（C错）。大定风珠由白芍、地黄、麦冬、龟板、牡蛎、鳖甲、阿胶、甘草、五味子、麻仁、鸡子黄等药组成，功能滋阴养液、柔肝熄风，方中鸡子黄、阿胶滋阴养液以熄内风；地黄、麦冬、白芍养阴柔肝；龟板、鳖甲、牡蛎育阴潜阳；麻仁养阴润燥；五味子、甘草酸甘化阴，诸药合用共奏滋阴养液，柔肝熄风之功（D错）。大秦艽汤为治风剂，具有疏风清热，养血活血之功效。主治风邪初中经络证。口眼斜，舌强不能言语，手足不能运动，或恶寒发热，苔白或黄，脉浮数或弦细（E对）。